张某是某医疗机构的医师，该医疗机构被市卫生局指定为艾滋病的定点咨询和初检机构。某日，正在张某值班过程中，艾滋病感染者刘某前来咨询，张某由于心里对艾滋病的恐惧，拒绝为刘某进行免费咨询，则对张某市卫生局应当作出的处罚是
A. 通告批评，予以警告
B. 降级
C. 撤职
D. 开除
E. 吊销张某的执业证书

正确答案：A。通告批评，予以警告